治疗肺痈咳吐脓血，热毒疮疡，其功效是
A. 祛风散寒除湿
B. 燥湿健脾
C. 清热解毒，排脓
D. 回阳，温肺化痰
E. 清热利尿通淋

正确答案：C。清热解毒，排脓

解析：清热解毒，排脓祛瘀；既可清热解毒，又善排脓祛瘀，并能清肺化痰（C对）。祛风寒湿药具有祛风、除湿、散寒、止痛、通经络等作用，治疗风寒湿痹，肢体关节疼痛，痛有定处，遇寒加重等（A错）。化湿药为芳香之品能醒脾化湿，温燥之药可燥湿健脾，治疗因湿浊引起的脾胃气滞（B错）。温里药中干姜具有温中散寒，回阳通脉，温肺化饮的功效，治疗脾胃寒证，脘腹冷痛，呕吐泄泻；亡阳证，肢冷脉微（D错）。利尿通淋药能清利下焦湿热，治疗热淋、血淋、石淋、膏淋（E错）。